对毫针补法的叙述，下列哪项是错误的
A. 病人吸气时进针，呼气时出针为补法
B. 进针时徐徐刺入，少捻转，疾速出针者为补法
C. 进针时针尖随着经脉循行去的方向刺入为补法
D. 出针后迅速按闭针孔为补法
E. 针下得气后，先浅后深，重插轻提，以下插用力为主者为补法

正确答案：A。病人吸气时进针，呼气时出针为补法

解析：呼吸补泻法在患者呼气时进针，吸气时出针为补法；在患者吸气时进针，呼气时出针为泻法（A错，为本题正确答案）。徐疾补泻法进针时徐徐剌入，疾速出针者为补法；进针时疾速刺入，徐徐出针者为泻法（B对）。迎随补泻法进针时针尖随着经脉循行去的方向刺入为补法，针尖迎着经脉循行来的方向刺入为泻法（C对）。开阖补泻法出针后迅速按闭针孔为补法；出针时摇大针孔而不按为泻法（D对）。提插补泻法针下得气后，先浅后深，重插轻提，以下插用力为主者为补法；先深后浅，轻插重提，以上提用力为主者为泻法（E对）。捻转补泻法针下得气后，拇指向前用力重，向后用力轻者为补法；拇指向后用力重，向前用力轻者为泻法。